恒牙龋病的易感时期为
A. 9～12岁
B. 10～13岁
C. 11～14岁
D. 12～15岁
E. 13～16岁

正确答案：D。12～15岁

解析：处于年轻期的恒牙尚未矿化完全，亦易患龋病，恒牙萌出至15岁是恒牙龋病的易感时期，因此，12～15岁是恒牙龋病的易感时期，患龋率又开始上升，此时加强年轻恒牙的防龋措施十分重要。25岁以后由于牙釉质的再矿化，增强了牙对龋的抵抗力，使患龋情况趋向稳定。掌握“龋病流行病学”知识点。